再生障碍性贫血最有诊断意义的检查方法是
A. 血常规检查
B. 骨髓穿刺检查
C. CT检查
D. 临床症状
E. 骨髓活检

正确答案：E。骨髓活检

解析：再生障碍性贫血主要发病主要是造血干细胞减少或有缺陷、骨髓造血微环境缺陷、免疫机制异常有关因此与骨髓功能密切相关，因此骨髓活检对诊断再生障碍性贫血最有诊断意义（E对）。血常规检查并不能用于确诊再障（A错）。骨髓活检再障病人做骨髓穿刺不易获得骨髓成分（B错）。CT一般不作为再障疾病的诊断检查（C错）。临床症状可以作为诊断的参考信息，但需要确诊再障则需要充分的实验室检查（D错）。